下列除哪项外，均为痛经气血虚弱证的主症
A. 腹痛出现在行经之后
B. 腹痛喜按
C. 月经量少、色淡、质稀
D. 神疲乏力，纳少便溏
E. 头晕眼花，腰痛如折

正确答案：E。头晕眼花，腰痛如折

解析：气血不足，冲任亦虚，子宫、冲任失于濡养，故腹痛可出现在经期或经期之后（A对）。子宫冲任失于濡养，故腹痛喜按（B对）。气血虚弱，血海未满而溢，故月经量少、色淡、质稀（C对）。气血虚弱，运化无权，故神疲乏力，纳少便溏（D对）。头晕眼花，腰痛如折为肾气亏损，风冷之邪乘之所致（E错，为本题正确答案）。